对于钠泵的叙述，错误的是
A. 是细胞膜上的镶嵌蛋白质
B. 具有ATP酶的活性
C. 可逆浓度梯度或电位梯度转运Na⁺和K⁺
D. 当细胞外钠离子浓度增多时被激活
E. 当细胞外钾离子浓度增多时被激活

正确答案：D。当细胞外钠离子浓度增多时被激活